患者，女，55岁，2型糖尿病史5年；心律失常病史2年，长期使用胺碘酮治疗。关于胺碘酮的不良反应的说法，错误的是
A. 可致肺毒性，早期一般表现为咳嗽但病情发展时可出现发热和呼吸困难，表现为急性肺炎
B. 可致甲状腺功能减退，较为常见，发病隐匿
C. 可掩盖低血糖症状(如心悸、手抖），但低血糖的其它症状(如出汗）仍然存在
D. 可致甲状腺功能亢进，同时会加重心房颤动或出现快速室性心律失常
E. 可致光过敏反应，日光暴露部位皮肤呈蓝灰色，应避免日晒或使用防晒用品

正确答案：C。可掩盖低血糖症状(如心悸、手抖），但低血糖的其它症状(如出汗）仍然存在

解析：本题考查胺碘酮。可掩盖低血糖症状是β受体阻断剂的效果，胺碘酮对血糖没有明显影响（C错，为本题正确答案）。胺碘酮可引起肺毒性（发生率15%～20%），起病隐匿，最短见于用药后1周，多在连续应用3～12个月后出现，早期一般表现为咳嗽，但病情发展时可出现发热和呼吸困难，表现为急性肺炎（A对）。甲状腺功能减退（1%～22%）较为常见、发生比较隐匿（B对）。胺碘酮可致甲状腺功能亢进（＜3%），加重心房颤动或出现快速室性心律失常（D对）。胺碘酮服药者常发生显著的光过敏（20%），最终一些患者日光暴露皮肤呈蓝灰色变（＜10%），严重影响美观，患者避免日晒或使用防晒用品（E对），可减轻症状。